某县有人口10万人，1997年因各种疾病死亡1000人。该年共发生结核300人，原有结核400人，1997年共有60人死于结核，请问：结核的病死率为
A. 60/300
B. 60/400
C. 60/700
D. 60/1000
E. 60/10万

正确答案：C。60/700

解析：本题考查病死率的计算。病死率表示一定时期内因某病死亡者占该病病人的比例。计算时分子为某时期内因某病死亡人数，分母为同期某病的病人数，计算得病死率为60/700（C对ABDE错）。